药用部位为果实的药材有
A. 决明子
B. 五味子
C. 蛇床子
D. 马钱子
E. 女贞子

正确答案：B、C、E。五味子；蛇床子；女贞子

解析：本题考查的是五味子、蛇床子与女贞子的来源。药用部位为果实的药材有五味子（B对）、蛇床子（C对）、女贞子（E对）。五味子【来源】为木兰科植物五味子的干燥成熟果实。习称“北五味子”。蛇床子【来源】本品为伞形科植物蛇床的干燥成熟果实。女贞子【来源】本品为木犀科植物女贞的干燥成熟果实。决明子（A错）【来源】为豆科植物决明或小决明的干燥成熟种子。马钱子（D错）【来源】为马钱科植物马钱的干燥成熟种子。